男，55岁。腹胀、少尿1年。曾诊断为“乙肝肝硬化”，未系统治疗。近1天呕血2次，量约500ml，排黑便1次，约100g，感头晕、心悸，于县医院急症就诊。既往有冠心病病史2年，间断口服药物治疗。查体：血压80/50mmHg，神志清，贫血貌，巩膜轻度黄染。心率108次/min，律齐。全腹无压痛及反跳痛，肝肋下未触及，脾肋下2cm，腹水征（+），肠鸣音活跃。按常规积极治疗6小时后，患者血色素继续下降，血压波动在80/50～70/40mmHg之间，下一步应采取的措施是
A. 立即转院
B. 维持原治疗方案
C. 三腔二囊管压迫止血
D. 加大升压药剂量
E. 开腹探查

正确答案：C。三腔二囊管压迫止血